囊壁中含有皮肤附件结构的囊肿是
A. 皮脂腺囊肿
B. 皮样囊肿
C. 表皮样囊肿
D. 鳃裂囊肿
E. 甲状舌管囊肿

正确答案：B。皮样囊肿

解析：皮样囊肿或表皮样囊肿为胚胎发育时期遗留于组织中的上皮细胞发展而来形成囊肿。皮样囊肿囊壁较厚，由皮肤和皮肤附件所构成。囊腔内有脱落的上皮细胞、皮脂腺、汗腺和毛发等结构，中医称为“发瘤”。其他囊肿均无此特殊组织表现。掌握“皮脂腺、皮样或表皮样囊肿”知识点。